患者，女，32岁。近两年来间断发生尿路刺激征，不发热，尿中查到白细胞与颗粒管型。应首先考虑的是：
A. 急性肾炎
B. 慢性肾炎
C. 急性肾盂肾炎
D. 慢性肾盂肾炎
E. 急性膀胱炎

正确答案：D。慢性肾盂肾炎

解析：患者近两年来间断发生尿路刺激征（考虑尿路感染），不发热（排除上尿路感染），尿中查到白细胞与颗粒管型（佐证尿路感染）。首先考虑为慢性肾盂性肾炎（D对）。急性肾炎、慢性肾炎属于肾小管疾病，其共同的临床表现为蛋白尿、血尿、水肿、高血压、肾功能异常（AB错）。急性肾盂肾炎临床表现与感染程度有关，通常起病较急，症状明显，有高热及腰痛的表现（C错）。膀胱炎主要表现为尿频、尿急、尿痛（尿路刺激征）。可有耻骨上方疼痛或压痛，部分病人出现排尿困难，尿液常浑浊，约 30% 可出现血尿，一般无全身感染症状（E错）。